患者咳嗽，查体：右侧呼吸动度减弱，右下肺叩诊出现浊音，听诊可闻及支气管呼吸音。应首先考虑的是
A. 右下肺不张
B. 右下肺实变
C. 右侧胸腔积液
D. 右侧气胸
E. 肺气肿

正确答案：B。右下肺实变

解析：本例患者有咳嗽病史，查体可发现右侧呼吸动度减弱，右下肺叩诊出现浊音，听诊可闻及支气管呼吸音，诊断首先考虑的是右下肺实变（B对）。右下肺不张（A错）患者查体可见右侧呼吸动度减弱，右下肺叩诊出现浊音，呼吸音减弱或消失，一般不会有支气管呼吸音。右侧胸腔积液（C错）患者查体可见右侧呼吸动度减弱，右肺叩诊出现实音，呼吸音减弱或消失。右侧气胸（D错）患者查体可见右侧呼吸动度减弱或消失，右肺叩诊出现鼓音，呼吸音减弱或消失。肺气肿（E错）患者查体可见双侧呼吸动度减弱，双肺叩诊出现过清音，呼吸音减弱。